葛根的功效有
A. 清肺润燥
B. 发表解肌
C. 疏肝解郁
D. 生津止渴
E. 清热燥湿

正确答案：B、D。发表解肌；生津止渴

解析：本题考查的是葛根的功效。葛根的功效有发表解肌（B对）与生津止渴（D对）。葛根：【功效】解肌退热，透疹，生津，升阳止泻。桑叶：【功效】疏散风热，清肺润燥（A错），平肝明目，凉血止血。柴胡：【功效】解表退热，疏肝解郁（C错），升举阳气。黄芩：【功效】清热燥湿（E错），泻火解毒，止血，安胎。